双侧四肢远端出现手套袜子样麻木，病变的定位多在
A. 神经丛
B. 神经末梢
C. 脊髓后角
D. 神经干
E. 脊髓后根

正确答案：B。神经末梢

解析：双侧四肢远端出现手套袜子样麻木，病变的定位多在神经末梢病变（B对）。神经丛（A错）和神经干（D错）损害表现为相应支配区的感觉障碍，伴有疼痛、下运动神经元性瘫痪和自主神经功能障碍等。脊髓后角（CE错）损害出现病灶相应皮节同侧痛温觉缺失、触觉保留的分离性感觉障碍（P22）。